小儿服用后可能引致骨骼损伤的是
A. 泻药与雌激素
B. 喹诺酮类抗菌药
C. 四环素类抗生素
D. 氨基糖苷类抗生素
E. 胃动力药

正确答案：B。喹诺酮类抗菌药

解析：本题考查特殊人群用药。小儿服用后可能引致骨骼损伤的是喹诺酮类抗菌药（B对）。儿童期运动系统发育较为稚嫩，骨骼肌相对柔弱，骺软骨处于不断增生和不断骨化的过程中。某些药物如喹诺酮类抗菌药物可引起关节痛、关节肿胀及软骨损害，影响骨骼发育。四环素（C错）与钙盐形成络合物，伴随钙盐沉积于牙齿及骨骼中，致使儿童牙齿黄染，影响骨质发育。氨基糖苷类抗生素（D错）可引起第Ⅷ对脑神经损伤。泻药与雌激素（A错）、胃动力药（E错）均无骨骼损伤的不良反应。